下列物质在混悬剂中均可发挥絮凝作用，其中絮凝作用最强的是
A. 氯化钠
B. 酒石酸钠
C. 枸橼酸钠
D. 三氯化铝
E. 苹果酸钠

正确答案：D。三氯化铝

解析：本题考查絮凝剂。对于絮凝剂，通常阴离子的絮凝作用大于阳离子，离子的价数越高，絮凝、反絮凝作用越强，三氯化铝（D对）絮凝作用强于氯化钠、酒石酸钠、枸橼酸钠以及苹果酸钠。